膜孔转运的特点是
A. 药物由高浓度区域向低浓度区域扩散
B. 需要能量
C. 借助于载体使非脂溶性药物由高浓度区域向低浓度区域扩散
D. 小于膜孔的药物分子通过膜孔进入细胞膜
E. 黏附于细胞膜上的某些药物随着细胞膜向内凹陷进入细胞内

正确答案：D。小于膜孔的药物分子通过膜孔进入细胞膜

解析：本题考查药物的转运方式。膜孔转运时，小于膜孔的分子可以通过膜孔进入细胞膜（D对），不需要能量（B错）；药物由高浓度区域向低浓度区域扩散（A错）为被动转运；借助于载体使非脂溶性药物由高浓度区域向低浓度区域扩散（C错）易化扩散；黏附于细胞膜上的某些药物随着细胞膜向内凹陷进入细胞内（E错）称为胞饮。